金匮肾气丸适用于糖尿病的
A. 阴虚阳盛证
B. 气阴两虚证
C. 阴阳两虚证
D. 阴阳欲绝证
E. 气滞血瘀证

正确答案：C。阴阳两虚证

解析：肾阳虚损，膀胱固摄失司，故见小便频数，混浊如膏，甚则饮一溲一；肾阳衰惫，阴寒内盛故见面色黧黑；肾阴不足故见耳轮焦干；肾阳虚衰，不能温养腰膝，故见腰膝酸软；元阳不足，失于温煦，故见形寒畏冷，阳痿不举，阳虚故见舌淡苔白，脉沉细无力。治法：滋阴温阳，补肾固摄。方药：金匮肾气丸加减（C对）。糖尿病气阴两虚证，症状：口渴引饮，能食与便溏并见，或饮食减少，精神不振，四肢乏力，体瘦，舌质淡红，苔白而干，脉弱。治法：益气健脾，生津止渴。方药：七味白术散加减（B错）。糖尿病分型：无症状期、症状期，阴虚燥热证，上消（肺热津伤证），中消（胃热炽盛证），下消（肾阴亏虚证）。气阴两虚证、痰瘀互结证、脉络瘀阻证、阴阳两虚证。糖尿病分型中没有阴虚阳盛证、阴阳欲绝证、气滞血瘀证（ADE错）。